薄膜衣片的崩解时限是
A. 10分钟
B. 20分钟
C. 30分钟
D. 40分钟
E. 60分钟

正确答案：C。30分钟

解析：本题考查薄膜衣片的崩解时限。薄膜衣片的崩解时限为30分钟（C对）。薄膜衣片应在 30 分钟内全部崩解。糖衣片应在1小时内（E错）全部崩解。